下列各项，不属于肝主疏泄功能的是
A. 调畅气机
B. 调畅情志
C. 促进骨骼发育
D. 促进脾胃的运化
E. 促进血液运行

正确答案：C。促进骨骼发育

解析：本题考查肝主疏泄的功能，属于理解记忆内容。肾主骨生髓的生理功能，说明促进骨骼发育是肾精及肾气促进机体生长发育功能的具体体现（C错，为本题正确答案）。